可引起子宫收缩导致胎儿窒息，妊娠期妇女须禁用的药品是
A. 谷氨酸钠
B. 头孢呋辛酯
C. 米诺环素
D. 麦角新碱
E. 阿莫西林

正确答案：D。麦角新碱

解析：本题考查妊娠期用药。麦角胺、麦角新碱（D对）等可引起子宫强直性收缩，作用较持久，主要用于产后出血，在胎盘娩出前禁用，否则可引起胎儿窒息死亡。